按照《执业药师资格制度暂行规定》掌握最新医药信息，保持较高的专业水平
A. 执业药师应履行的职责
B. 对执业药师继续教育的要求
C. 执业药师应遵守的基本准则
D. 执业药师注册的规定
E. 执业药师再注册的规定

正确答案：B。对执业药师继续教育的要求